25岁，已婚妇女，婚后2年不孕，月经尚规律，停经45天后，阴道出血1个月，量少，无腹痛，妇检：宫颈充血，较软，子宫稍大，亦较软，附件（-），宫颈粘液涂片为羊齿状结晶，尿妊娠试验（-）为同时解决不孕问题，同步进行的治疗应为
A. 克罗米酚50mg/d×5，月经第5天口服
B. hCG于月经来潮前肌注
C. 人工授精
D. 雌-孕激素合并疗法
E. 口服避孕药

正确答案：A。克罗米酚50mg/d×5，月经第5天口服

解析：克罗米酚的作用是促排卵。宫颈粘液涂片为羊齿状结晶说明无排卵，需要应用促排卵药来解决不孕问题。掌握“功能失调性子宫出血”知识点。